患者31岁，12月末发病，头痛，发热，恶心，呕吐，腰痛4天，体检：面色潮红，结膜充血，腋下可见点状出血，化验：白细胞15×10⁹/L，中性粒72%，淋巴20%。异淋8%，尿蛋白（+++），已确诊为肾综合征出血热。下列诸项中哪项是肾综合征出血热特征性改变
A. 病程长短
B. 热退后症状加重
C. 血尿的情况
D. 贫血程度
E. 颅内压力

正确答案：B。热退后症状加重

解析：肾综合征出血热特征性改变的是热退后症状加重（B对）。病程长短、血尿情况、贫血程度及颅内压力都与病情严重程度有关，而不是特征性改变。